提示血容量不足
A. 中心静脉压很低，尿量多
B. 中心静脉压偏低，尿量少
C. 中心静脉压偏低，尿量多
D. 中心静脉压很高，尿量多
E. 中心静脉压很高，尿量少

正确答案：B。中心静脉压偏低，尿量少

解析：中心静脉压代表了右心房或者胸腔段腔静脉内压力变化，可反映全身血容量与右心功能的关系，中心静脉压低表示血容量不足；尿量反映肾脏的灌注，尿量少说明肾脏灌注少，进一步说明血容量不足。综上，中心静脉压偏低，尿量少提示血容量不足（B对）。一般不存在中心静脉压低，尿量多的临床表现（AC错）。中心静脉压很高，尿量多，提示血容量过多（D错）。中心静脉压很高，尿量少，提示心功能不全（E错）。